属于N₁型胆碱能受体阻断剂的是
A. 十烃季铵
B. 阿托品
C. 六烃季铵
D. 酚妥拉明
E. 普萘洛尔

正确答案：C。六烃季铵

解析：属于N₁型胆碱能受体阻断剂的是六烃季铵（C对）。十烃季铵（A错）主要拮抗N2受体。阿托品（B错）主要拮抗M受体。酚妥拉明（D错）能阻断α受体，包括α1和α2受体，但主要阻断α1受体。普奈洛尔（E错）是β受体的拮抗剂。